由上运动神经元发出的纤维束是
A. 皮质脊髓束
B. 听辐射
C. 丘脑中央辐射
D. 脊神经
E. 脑神经

正确答案：A。皮质脊髓束

解析：上运动神经元起自中央前回和中央旁小叶前部的巨型锥体细胞 (Betz 细胞）和其他类型的锥体细胞，下行至脊髓的纤维束称皮质脊髓束（A对） ; 止于脑干内一般躯体和特殊内脏运动核的纤维束称皮质核束。